医学修养中所指的“慎独”是出自
A. 《大医精诚》
B. 《礼记中庸》
C. 《黄帝内经》
D. 《物理论》
E. 《本草纲目》

正确答案：B。《礼记中庸》

解析：“慎独”始终是儒家富有特色的道德修养方法，强调有修为的君子，应该人前人后行为一致，有人知无人知行为一致。在医学道德修养层面，“慎独”相对于“共处”而言，是指医务人员在无人知晓与评价时，自觉按照医学道德要求实践医德行为的境界（B对）。